吸宫术后，持续阴道出血，发热，下腹痛。应首先考虑的是
A. 人工流产综合征
B. 子宫穿孔
C. 吸宫不全合并感染
D. 宫腔粘连
E. 空气栓塞

正确答案：C。吸宫不全合并感染

解析：下腹疼痛，腰痛，阴道分泌物混浊均是因为吸宫不全，瘀血或胚胎残留在体内，阻塞血道，恶露排除不畅，发热的是炎症表现（C对）。人工流产综合征诊断要点有头晕、恶心、呕吐、面色苍白及出冷汗，甚至晕厥等（A错）。子宫穿孔诊断要点有宫腔深度超过应有深度，且无到底感；吸引过程中突感阻力消失或有突破感，同时吸管进入而无到底的感觉；腹痛剧烈，或有内脏牵拉感，严重时可有出汗、面色苍白、血压下降；内出血或腹膜刺激征象；吸出物或夹出物系宫腔以外的组织，如脂肪、肠管或输卵管等；双合诊时子宫穿孔局部有明显压痛（B错）。宫腔粘连诊断要点人流术后闭经或月经过少，伴周期性下腹胀痛，肛门坠胀感；妇科检查子宫稍大，压痛明显，宫颈举痛，附件压痛，探针探查宫腔时不能顺利进入，或进入后引流出暗红色血液（D错）。空气栓塞开始患者感觉不明显，随着空气栓子随血液流动至心肺部，会出现胸部异常不适或胸骨后疼痛，随即出现呼吸困难、严重发绀、伴濒死感，心前区听诊可闻及响亮的、持续的“水泡声”（E错）。